男，32岁。反复皮肤紫癜1个月，加重并腹痛2天。查体：四肢皮肤散在紫癜，心肺未见异常，腹平软，脐周轻压痛，无反跳痛和肌紧张，肝脾肋下未触及，肠鸣音6次/分。临床诊断为过敏性紫癜。可证实上述诊断类型的检查结果是
A. 大关节肿胀，有压痛
B. 尿常规异常（血尿、蛋白尿、管型尿）
C. 粪常规异常（有红细胞，隐血阳性）
D. 粪隐血阳性、尿沉渣镜检红细胞6-8/Hp
E. 毛细血管脆性试验

正确答案：C。粪常规异常（有红细胞，隐血阳性）

解析：过敏性紫癜包括单纯型（紫癜型）、腹型（Henoch型）、关节型（Schonlein型）、肾型和混合型。该患者除有四肢皮肤散在紫癜外，还有腹痛和脐周轻压痛等腹部症状，最有可能的临床类型是腹型（Henoch型），其粪常规可异常（有红细胞、隐血阳性）（C对）。大关节肿胀，有压痛（A错）是关节型的表现。尿常规异常（血尿、蛋白尿、管型尿）（B错）是肾型的表现。粪隐血阳性、尿沉渣镜检红细胞6-8/Hp（D错）为混合型的特点。毛细血管脆性试验（E错）为过敏性紫癜共有的特点。